因半衰期较长，无需强调晚间或睡前服用的药物是
A. 瑞舒伐他汀
B. 辛伐他汀
C. 洛伐他汀
D. 普伐他汀
E. 氟伐他汀

正确答案：A。瑞舒伐他汀

解析：本题考查他汀类药物的使用时间。因半衰期较长，无需强调晚间或睡前服用的药物是瑞舒伐他汀（A对）。洛伐他汀（C错）、辛伐他汀（B错）、普伐他汀（D错）、氟伐他汀（E错）半衰期均较短，建议在晚间或睡前服用。